慢性肾功能不全出现肾性贫血最合适的治疗药物是
A. 口服碳酸钙
B. 必需氨基酸疗法
C. 补充1，25-（OH）₂-D3
D. 促红细胞生成素
E. 血液透析治疗

正确答案：D。促红细胞生成素

解析：慢性肾功能不全出现肾性贫血最合适的治疗药物是促红细胞生成素（D对），一般开始用量为每周80～120U/kg，分2～3次（或每次2000～3000U，每周2～3次），皮下或静脉注射，并根据患者Hb水平、Hb升高速率等调整剂量；以皮下注射更为理想，既可达到较好疗效，又可节约用量1/4～1/3。必需氨基酸疗法（八版内科学P530）（B错）主要用于肾功能不全且需要限制蛋白质摄入的患者，但并不可用于降血钾。补充1，25-(OH）₂-D3（P525）（C错）可通过肠壁增加磷的吸收，并通过肾小管增加磷的再吸收，但对血钾浓度没有影响。血液透析治疗（P524）（E错）主要用于急慢性肾脏功能衰竭患者。